心肌自律性最高的部位是
A. 窦房结
B. 心房肌
C. 心室肌
D. 房室交界
E. 浦肯野纤维

正确答案：A。窦房结

解析：自律性是指心肌在无外来刺激条件下能自动产生节律性兴奋的能力或特性。窦房结（A对）P细胞是心脏的正常起搏点，自律性最高，约100次/分。房室交界（D错）、房室束、浦肯野纤维（E错）的自律性分别为50、40、25次/分。心房肌（B错）、心室肌（C错）是工作细胞，没有自律性。